心经的络穴是
A. 少府
B. 神门
C. 阴郄
D. 灵道
E. 通里

正确答案：E。通里

解析：灵道为手少阴心经的经穴（D错）。阴郄为手少阴心经的郄穴（C错）。神门为手少阴心经的腧穴、原穴（B错）。少府为手少阴心经的荥穴（A错）。通里为手少阴心经的络穴（E对）。络穴趣记，公孙在内外关这样偏沟里，缺少支持，为了丰隆飞向光明。公孙、内关、外关、偏历、蠡沟、通里、列缺、支正、丰隆、飞扬、光明。